根据《疫苗流通和预防接触管理条例》，下列疫苗中，不属于一类疫苗的是
A. 国家免疫规划确定的疫苗
B. 公民自费并自愿受种的疫苗
C. 公民应依照政府规定受种的疫苗
D. 县级以上人民政府组织应急接种疫苗
E. 卫生主管部门组织的群体性预防接种所使用的疫苗

正确答案：B。公民自费并自愿受种的疫苗

解析：本题考查疫苗的概念。第一类疫苗为政府免费向公民提供，公民应根据政府的规定受种的疫苗。公民自费并自愿受种的疫苗（B错，为本题正确答案）不属于第一类疫苗。